外用杀虫止痒，内服壮阳通便的药物是
A. 雄黄
B. 硫黄
C. 杜仲
D. 巴戟天
E. 蛇床子

正确答案：B。硫黄

解析：硫黄的功效为外用解毒疗疮、杀虫止痒；内服补火助阳通便（B对）。雄黄的功效为解毒杀虫，燥湿祛痰，截疟（A错）。杜仲的功效为补肝肾，强筋骨，安胎（C错）。巴戟天的功效为补肾阳，强筋骨，祛风湿（D错）。蛇床子的功效为燥湿祛风，杀虫止痒，温肾壮阳（E错）。